杂环胺致癌的主要靶器官为
A. 肝脏
B. 胃
C. 脂肪组织
D. 血液
E. 骨骼

正确答案：A。肝脏

解析：本题考查杂环胺致癌的主要靶器官。机体解毒能力与代谢活化的相对强度，是决定杂环胺致突变性、致癌性的重要因素之一。杂环胺致癌的主要靶器官为肝脏（A对BCDE错）。